下列哪种后果不是生殖细胞突变引起的
A. 显性致死
B. 显性遗传病
C. 隐性遗传病
D. 癌症

正确答案：D。癌症

解析：本题考查生殖细胞突变引起的后果。突变发生在生殖细胞，无论其发生在任何阶段，都可能会对后代产生影响，其后果可分为致死性和非致死性两种。致死性影响可能是显性致死（A对）和隐性致死。如果生殖细胞突变为非致死性，则可能出现显性（B对）或隐性遗传病（C对）。癌症（D错，为本题正确答案）是体细胞突变的后果。